某男，42岁。自诉感冒数日，恶寒渐轻，身热增盛，无汗头痛，目疼鼻干，心烦不眠。经中医辨证为外感风寒、郁而化热。处以柴葛解肌汤，药用柴胡、葛根、甘草、黄芩、羌活、白芷、白芍、桔梗、石膏，水煎服。处方中，含有三萜皂苷类成分，且具有解热、抗炎、抗病毒和保肝作用的饮片是
A. 柴胡
B. 葛根
C. 桔梗
D. 羌活
E. 白芷

正确答案：A。柴胡

解析：本题考查的是含三萜皂苷类化合物的常用中药。处方中，含有三萜皂苷类成分，且具有解热、抗炎、抗病毒和保肝作用的饮片是柴胡（A对）。柴胡中含有的总皂苷为1.6%～3.8%。柴胡中所含皂苷均为三萜皂苷，柴胡皂苷是柴胡的主要有效成分。《中国药典》以柴胡皂苷a和柴胡皂苷d为指标成分对柴胡药材进行含量测定。要求两者的总含量不少于0.30%。柴胡的药理作用：（1）解热、镇痛、抗炎。（2）保肝、利胆、降血脂。葛根（B错）含异黄酮类化合物，主要成分有大豆素、大豆苷、大豆素-7，4'-二葡萄糖苷及葛根素、葛根素-7-木糖苷。《中国药典》以葛根素为指标成分进行含量测定，要求含葛根素不得少于2.4%。葛根的药理作用：（1）解热。（2）降血糖、降血脂。（3）抗心肌缺血、抗脑缺血。桔梗（C错）含桔梗皂苷，能开提肺气、宣肺利咽，善治咳嗽痰多、咽痛音哑。羌活（D错）能散风寒湿止痛。白芷（E错）含挥发油。